牙龈当中的胶原纤维束存在于
A. 上皮层
B. 固有层
C. 黏膜层
D. 黏膜下层
E. 棘层

正确答案：B。固有层

解析：牙龈固有层含有多种细胞成分，主要是成纤维细胞，故此层由致密结缔组织构成。其中胶原纤维束呈各种方向排列，使牙龈与深部组织稳固贴附。掌握“牙龈”知识点。